阳和解凝膏的功能是
A. 软坚散结，活血消痈
B. 散结消肿，化瘀止痛
C. 活血化瘀，燥湿清热
D. 活血消肿，去腐生肌
E. 温阳化湿，消肿散结

正确答案：E。温阳化湿，消肿散结

解析：本题考查的是阳和解凝膏的功能。阳和解凝膏的功能是温阳化湿，消肿散结（E对）。阳和解凝膏：【功能】温阳化湿，消肿散结。乳癖消胶囊：【功能】软坚散结，活血消痈（A错），清热解毒。小金丸：【功能】散结消肿，化瘀止痛（B错）。当归苦参丸：【功能】活血化瘀，燥湿清热（C错）。京万红软膏：【功能】活血解毒，消肿止痛，去腐生肌（D错）。